关于受试者工作特征曲线（ROC曲线）的论述下列哪项不正确
A. ROC曲线可表示灵敏度与特异度的关系
B. ROC曲线常被用来直观地确定诊断试验的最佳截断值
C. ROC曲线是以灵敏度为纵坐标，特异度为横坐标
D. 用ROC曲线确定最佳截断值处，其灵敏度和特异度均较好，误诊率和漏诊率均较低
E. 对同一种疾病的不同诊断方法进行比较时，若将各试验的ROC曲线绘制到同一坐标图中，则ROC曲线下面积最大的试验其真实性最佳

正确答案：C。ROC曲线是以灵敏度为纵坐标，特异度为横坐标

解析：本题考查ROC曲线。ROC曲线基本原理：将病人和非病人的测量值从小至大排序，即可划分一系列截断值。对应每个截断值可计算相应的灵敏度和特异度（A对）。绘制1-特异度为横坐标，灵敏度为纵坐标的坐标轴（C错，为本题正确答案），每个截断值对应的灵敏度和1-特异度值构成坐标点，多个坐标点相连即ROC曲线。距离坐标轴左上角最近的坐标点，可同时满足筛检试验的灵敏度和特异度相对最优，它所对应的取值即最佳截断值（B对）。用ROC曲线确定最佳截断值处，其灵敏度和特异度均较好，误诊率和漏诊率均较低（D对）。对同一种疾病的不同诊断方法进行比较时，若将各试验的ROC曲线绘制到同一坐标图中，则ROC曲线下面积最大的试验其真实性最佳（E对）。